男，75岁。进行性吞咽困难3月余，目前能进半流食。胃镜检查：食管距门齿20cm处发现一长约6cm菜花样肿物，病理报告为鳞状细胞癌。其最佳治疗方法为
A. 食管癌根治术
B. 姑息食管癌切除术
C. 化疗
D. 胃造瘘术
E. 放疗

正确答案：E。放疗

解析：食管癌的分段与距离门齿的关系如下：颈段下端距离上门齿约20cm；胸上段下端距上门齿约25cm；胸中段下端约距离上门齿30cm；胸下段下端距上门齿约40cm。胸部中下段食管癌通常首选手术治疗，颈部及胸部上段食管癌由于前方有主动脉弓，气管分叉等结构，手术难度大，常行放射治疗。该病人癌块距门齿20cm，属于颈段下端食管癌，因此最佳治疗方法为放疗（E对），不宜行食管癌根治术（A错）、姑息性食管癌切除术（B错）、胃造瘘术（D错）等手术治疗。化疗（C错）多用于食管癌术前、术后的辅助治疗，不是该患者的最佳治疗方法。